已知某筛检试验的灵敏度和特异度，用该试验筛检两个人群，其中甲人群的患病率为10%，乙人群为1%，下述描述正确的是
A. 甲人群筛检阴性者中假阴性所占比例比乙人群低
B. 甲人群筛检的特异度比乙人群低
C. 甲人群筛检的可靠性比乙人群高
D. 甲人群筛检阳性者中假阳性所占比例比乙人群低
E. 甲、乙两人群的阳性预测值相同

正确答案：D。甲人群筛检阳性者中假阳性所占比例比乙人群低